糖衣片出现片面不平是由于
A. 撒粉太多，温度过高，衣层未干就包第二层
B. 有色糖浆用量过少且未搅匀
C. 衣层未干就加蜡打光
D. 片芯层或糖衣层末充分干燥
E. 衣料用量不当，温度过高或吹风过早

正确答案：A。撒粉太多，温度过高，衣层未干就包第二层